发生在肝生化转化第二阶段的是
A. 葡萄糖醛酸结合反应
B. 氧化反应
C. 还原反应
D. 水解反应
E. 酯化反应

正确答案：A。葡萄糖醛酸结合反应

解析：肝的生物转化过程包括两个阶段，即两相反应。第一相反应包括氧化（B错）、还原（C错）和水解（D错）；第二相反应包括结合反应，其中，葡糖醛酸结合反应（A对）最重要和最普遍。酯化反应（E错）不属于肝生物转化过程。